下列有关食物嵌塞的临床症状，说法正确的是
A. 口腔异味
B. 牙龈红肿
C. 龈乳头炎
D. 持续性胀痛
E. 以上说法均正确

正确答案：E。以上说法均正确

解析：症状：龈乳头炎，挤压感和持续性胀痛；牙龈红肿、出血；牙龈退缩；口腔异味。掌握“修复体戴入后的问题及处理”知识点。